治疗侵袭性曲霉菌病首选
A. 伏立康唑
B. 氟胞嘧啶
C. 氟康唑
D. 灰黄霉素
E. 特比萘芬

正确答案：A。伏立康唑

解析：本题考查伏立康唑。治疗侵袭性曲霉菌病首选伏立康唑（A对）。侵袭性曲霉菌病：首选伏立康唑。推荐伏立康唑+卡泊芬净。可选：两性霉素B（脂质体两性霉素B）。氟胞嘧啶（B错）治疗播散性真菌病时通常与两性霉素B联合应用，因单独应用时易致真菌耐药性的发生。氟康唑（C错）是侵袭性念珠菌病的首选药。灰黄霉素（D错）适用于由表皮癣菌属、小孢子菌属和毛癣菌属引起的皮肤真菌感染。临床上主要用于头癣、严重体股癣、叠瓦癣、手足甲癣等，对头癣的疗效较明显。特比萘芬（E错）是丙烯胺类抗真菌药，目前是作为皮肤癣菌病的首选。